口开目合，全身瘫软，神识朦胧，属于
A. 气虚证
B. 气陷证
C. 气不固证
D. 气脱证
E. 血脱证

正确答案：D。气脱证

解析：气脱证多由气虚、气不固发展而来；脾气外泄，则口开目合，全身瘫软；心气外脱，则神识朦胧；故辨证为气脱证（D对）。气虚证表现为神疲乏力，少气懒言，气短，头晕目眩，自汗，动则诸症加剧，舌质淡嫩，脉虚（A错）。气陷证表现为头晕眼花，神疲气短，腹部坠胀，或久泄久痢，或见内脏下垂、脱肛、阴挺等，舌质淡嫩，脉虚（B错）。气不固证表现为气短，疲乏，面白，舌淡嫩，脉虚，或自汗不止；或流涎不止；或遗尿，余溺不尽，小便失禁（C错）。血脱证表现为面色苍白，头晕，眼花，心悸，舌淡或枯白，脉微或芤，且与血虚症状共见（E错）。